队列研究的样本组成
A. 病例组与对照组
B. 实验组与非实验组
C. 暴露与非暴露组
D. 无病个体随机分组

正确答案：C。暴露与非暴露组

解析：本题考查队列研究的原理。队列研究是将人群按是否暴露于某可疑因素及其暴露程度分为不同的暴露组和非暴露组（C对ABD错），追踪其各组的结局，比较不同组之间结局频率的差异，从而判定暴露因素与结局之间有无因果关联及关联大小的一种观察性研究方法。